牙本质龋最前沿的改变是
A. 牙本质脱矿
B. 细菌侵入
C. 形成透明层
D. 发生脂肪变性
E. 牙本质破坏崩解

正确答案：D。发生脂肪变性

解析：本题考查牙本质龋。牙本质龋最前沿的改变是发生脂肪变性（D对）。透明层又称硬化层，为牙本质龋最深层、最早出现的改变。在细菌侵入之前，部分区域牙本质小管内成牙本质细胞突起在细菌酶的作用下，细胞膜等有机成分发生脂肪变性，光镜下呈云雾状，曾称此区域为脂肪变性层。在脂肪变性的基础上，也可发生矿物盐晶体的沉着，形成透明层。